营养臀大肌的主要动脉是
A. 臀上动脉
B. 臀下动脉
C. 闭孔动脉
D. 穿动脉
E. 无

正确答案：B。臀下动脉

解析：臀下动脉（B对）为营养臀大肌的主要动脉，其分支营养下部的臀肌和髋关节。